患者，男，40岁。胃脘灼热疼痛，痛势急迫，烦怒，口苦，泛吐酸水，舌红苔薄黄，脉弦数。治疗应首选
A. 化肝煎
B. 黛蛤散
C. 小柴胡汤
D. 柴胡疏肝散
E. 龙胆泻肝汤

正确答案：A。化肝煎

解析：肝气郁结，日久化热，邪热犯胃，故见胃脘灼热疼痛，痛势急迫；肝胃郁热，逆而上冲，故烦躁易怒，泛吐酸水；肝胆互为表里，肝热夹胆火上乘，故口苦；舌红苔薄黄，脉弦数，均为肝热犯胃证的特点；治宜清肝泻热，和胃止痛，用化肝煎加减（A对）。黛蛤散（B错）清肝热。小柴胡汤（C错）和解少阳。柴胡疏肝散（D错）舒肝理气，不能清热。龙胆泻肝汤（E错）清利肝胆湿热。